在低地方流行区，乙型肝炎在儿童中
A. 少见
B. 多见
C. 一般
D. 较多见
E. 肯定不会发生

正确答案：A。少见